确定某病与某因素联系的强度时应用
A. 某病的发病率
B. 某病的死亡率
C. 某病的患病率
D. 相对危险度
E. 某人群与某因素接触频率

正确答案：D。相对危险度

解析：本题考查相对危险度的概念。相对危险度（D对ABCE错）（RR）通常包括了危险度比或率比。危险度比和率比都是反映暴露与发病（死亡）关联强度的最有用的指标。